下述哪种物质是体内合成胆碱的原料
A. 肌醇
B. 苏氨酸
C. 丝氨酸
D. 甘氨酸
E. 核酸

正确答案：C。丝氨酸